下列各项，可出现双侧瞳孔散大的是
A. 阿托品影响
B. 氯丙嗪影响
C. 有机磷农药中毒
D. 毒蕈中毒
E. 毛果云香碱中毒

正确答案：A。阿托品影响

解析：阿托品中毒后可出现口干、吞咽困难、皮肤干燥潮红、瞳孔散大、视力模糊、心动过速、排尿困难等症状，故可出现双侧瞳孔散大的是阿托品影响（A对）。氯丙嗪影响表现为口干，乏力，嗜睡，便秘，心悸等（B错）。有机磷中毒表现为恶心、呕吐、腹痛、多汗、流泪、流涕、流涎、腹泻、尿频、大小便失禁、心跳减慢、瞳孔缩小、支气管痉挛和分泌物增加等（C错）。毒蕈中毒表现为剧烈恶心、呕吐、腹泻、腹痛、流涎、流泪、多汗、瞳孔缩小及脉搏缓慢等（D错）。毛果云香碱中毒表现为眉弓部疼痛，暂时性近视，瞳孔后粘连，虹膜囊肿等（E错）。